下列四种发疹性疾病中，白细胞增高者为
A. 麻疹
B. 风疹
C. 猩红热
D. 幼儿急疹
E. 以上都是

正确答案：C。猩红热

解析：猩红热是化验血常规：白细胞总数可达（10～20）×10⁹/L或更高，中性粒细胞百分比大于80%，有时可见到中毒颗粒（C对）。麻疹（A错）化验血常规：外周血白细胞总数减少，淋巴细胞相对增多。并发细菌感染时，可见白细胞总数及中性粒细胞增加；淋巴细胞严重减少，提示预后不良。风疹（B错）化验血常规：白细胞计数正常或稍减低，淋巴细胞相对增多，可见异型淋巴细胞。幼儿急疹（D错）化验血常规：白细胞计数明显减低，淋巴细胞增高，最高可达90%以上，淋巴细胞包括非典型性淋巴细胞。选项以上都是不符合题意（E错）。